邻（牙合）洞邻面部分龈方大于（牙合）方是因为
A. 防止修复体侧向脱位
B. 防止修复体垂直脱位
C. 因釉柱的排列方向影响
D. 因牙本质小管的排列方向影响
E. 节约填充材料

正确答案：B。防止修复体垂直脱位

解析：本题考查窝洞的固位形-梯形固位。梯形固位指邻（牙合）洞的邻面部分制备成龈方大于（牙合）方的梯形，其目的是防止充填体垂直方向的脱位（B对）。防止修复体侧向脱位的固位形有侧壁固位、鸠尾固位（A错）。